下列疾病的预防以第一级预防为主要控制策略的是
A. 结肠直肠癌
B. 类风湿关节炎
C. 乳腺癌
D. 胰腺癌
E. 碘缺乏病

正确答案：E。碘缺乏病

解析：碘缺乏病（E对）的预防以一级预防为主要控制策略。一级预防是在疾病尚未发生时针对病因采取的措施，也是预防、控制和消灭疾病的根本措施。碘缺乏病可以通过改善食入碘的量来达到预防的目的，针对的是危险因素“缺碘”。结肠直肠癌（A错）、类风湿关节炎（B错）、乳腺癌（C错）、胰腺癌（D错）更加注重的是第二、三级预防，目的在于延缓疾病的发展，以及防止伤残，加强预后，延长寿命。